关于防止药物水解的方法，错误的是
A. 调节pH值
B. 降低温度
C. 改变溶剂
D. 制成固体制剂
E. 通入惰性气体

正确答案：E。通入惰性气体